下列除哪项外，指下均有脉气紧张之感觉
A. 弦
B. 紧
C. 长
D. 革
E. 牢

正确答案：C。长

解析：长脉的脉象特点为柔和之长脉而非脉气紧张（C对）。弦脉，因弦是脉气紧张的表现（A错）。紧脉的脉象特点是脉势紧张有力，坚搏抗指，脉管的紧张度、力度均比弦脉高（B错）。革脉的脉象特点是浮取感觉脉管搏动的范围较大而且较硬，有搏指感，但重按则乏力，有豁然而空之感，因而恰似以指按压鼓皮上的外急内空之状（D错）。牢脉的脉象特点是脉位沉长，脉势实大而弦（E错）。